男，28岁。急性化脓性阑尾炎接受阑尾切除术后5小时，再次出现腹痛，伴烦躁、焦虑。查体：T37.8℃，P130次／分，BP80/60mmHg，面色苍白，皮肤湿冷，双肺呼吸音清，未闻及啰音，腹胀，全腹轻度压痛，轻度肌紧张，未闻及肠鸣音。该病人首先要注意排除的危急情况是
A. 术后出血
B. 肠瘘
C. 粘连性肠梗阻
D. 盆腔脓肿
E. 切口裂开

正确答案：A。术后出血

解析：青年男性，急性化脓性阑尾炎接受阑尾切除术后5小时，再次出现腹痛，伴失血性休克表现：烦躁、焦虑、面色苍白、皮肤湿冷、血压80/60mmHg（正常值：收缩压90-139mmHg，舒张压60-89mmHg），最可能的诊断为术后出血（A对）。粘连性肠梗阻（P360）（C错）主要表现为腹痛、呕吐、腹胀、排气排便停止，绞窄性肠梗阻病人可出现全身中毒症状及休克。盆腔脓肿（P375）（D错），是阑尾炎未经及时治疗的后果。术后肠瘘（P376）（B错）少见且无明显休克表现。切口裂开（E错），近年来随着外科技术的提高，此并发症已较少见。